下列哪个违背了学校心理咨询的原则
A. 保护咨询者的个人及家庭隐私
B. 建议学生找心理咨询老师聊聊
C. 咨询师不让咨询者过分依赖
D. 每次限定咨询时间
E. 替咨询者作出决定

正确答案：E。替咨询者作出决定